使足内翻的肌是
A. 腓肠肌
B. 胫骨前肌
C. 腓骨长肌
D. 腓骨短肌
E. 比目鱼肌

正确答案：B。胫骨前肌

解析：腓肠肌（A错）和比目鱼肌（E错）均屈踝关节和膝关节。胫骨前肌（B对）伸踝关节和使足内翻。腓骨长肌（C错）和腓骨短肌（D错）均屈踝关节和使足外翻。